下列哪种情况能用哌替啶而不宜用吗啡
A. 镇痛
B. 镇咳
C. 止泻
D. 人工冬眠
E. 心源性哮喘

正确答案：D。人工冬眠

解析：本题考查哌替啶的临床应用。哌替啶与氯丙嗪、异丙嗪组成人工冬眠合剂，用于人工冬眠（D对）。